坏死性唾液腺化生的病理表现描述正确的是
A. 溃疡周围表面上皮萎缩
B. 腺小叶增生明显
C. 黏液外溢形成黏液池
D. 导管上皮纤维化
E. 腺泡间质玻璃样变

正确答案：C。黏液外溢形成黏液池

解析：坏死唾液腺化生的镜下见溃疡周围的表面上皮呈假上皮瘤样增生，腺小叶坏死，腺泡壁溶解消失，黏液外溢形成黏液池；腺导管上皮呈明显的鳞状化生，形成大小不等的上皮岛或上皮条索。有的腺小叶完全被鳞状细胞团片取代。掌握“坏死性唾液腺化生与舍格伦综合征”知识点。